维生素C的良好食物来源是
A. 粮谷类
B. 蔬菜、水果
C. 动物性食品
D. 豆类
E. 植物油

正确答案：B。蔬菜、水果